初产妇，26岁。妊娠41周，宫口开全1小时30分，胎心114次/分，胎膜已破，羊水浑浊绿色，枕右前位，S+4。此时恰当的处理是
A. 立即剖宫产
B. 低位产钳助娩
C. 胎头吸引术助娩
D. 吸氧，等待自然分娩
E. 静脉滴注缩宫素加速产程进展

正确答案：B。低位产钳助娩